预防药物性肾损伤，需要严格掌握各种药物的适应症，避免滥用。关于用药注意事项的说法，错误的是
A. 含重金属成分的中药可小剂量长期服用
B. 对某些有肾损害高危因素者，药物应慎用或减量
C. 数种药物并用时，注意药物间的相互作用
D. 因慢性病需长期服用可能累积的药物，应采用少量、间断服药的方法
E. 一旦发现有肾损害，应立即停药，并给予相应处理

正确答案：A。含重金属成分的中药可小剂量长期服用

解析：本题考查的是中药引起肾损害的防治原则。含重金属成分的中药即使是小剂量长期服用也易蓄积致肾损害（A错，为本题正确答案）。中药引起肾损伤的防治原则：预防药物性肾损伤，首先要严格掌握各种药物应用的适应证，避免滥用。其次也应注意下述事项。1.药物应用中注意剂量、疗程，用药期间严密监测尿酶、尿蛋白及肾功能。对某些有肾损害高危因素者，药物应慎用或减量（B对）。如婴幼儿、营养状况差、肾功能不全者，应尽量避免使用本类药物；必须要用的，应根据具体情况减量或延长给药间隔时间。2.数种药物并用时，注意药物间的相互作用（C对）。3.部分中草药有特殊煎煮时间要求，如山豆根煎煮时间越长，则毒性作用越强。因此应搞清不同中草药的煎煮时间。同时煎煮器具选择不当，也可致毒，应避免用铝锅、铁锅煎药。4.如果因慢性病需长期服用某类中药，对有蓄积可能的药物，应采用少量、间断服药的方法（D对）。含金属矿石成分的中药一般排泄极为缓慢，不但一次用量要严格控制，若长期服用，即使小剂量也易蓄积致肾损害。5.一旦发现有肾损害，应立即停药，根据不同药物种类及其临床表现给予相应处理（E对）。